宫颈癌的转移分为两级的是
A. 直接蔓延
B. 医源转移
C. 血行转移
D. 腺行转移
E. 淋巴转移

正确答案：E。淋巴转移

解析：本题考查宫颈癌。宫颈癌的淋巴结转（E对）移分为两级：一级组包括子宫旁、宫颈旁或输尿管旁、闭孔、髂内、髂外淋巴结；二级组包括髂总、腹股沟深、浅及腹主动脉旁淋巴结。